张力性气胸造成呼吸、循环障碍的机理是
A. 胸壁软化，反常呼吸
B. 肺组织挫伤，换气受阻
C. 肺泡间质水肿，换气受阻
D. 患侧肺萎陷，纵隔向健侧移位
E. 严重皮下气肿，肺内气体流失

正确答案：D。患侧肺萎陷，纵隔向健侧移位

解析：张力性气胸患者伤侧胸膜腔压力显著增高，导致患侧肺萎陷，纵隔向健侧移位，压迫健侧肺，造成呼吸、腔静脉回流（即循环）障碍（D对）。胸壁软化，反常呼吸（A错）是多根多处肋骨骨折的典型表现。肺组织挫伤（B错）、肺泡间质水肿（C错）可导致氧弥散障碍，出现低氧血症，一般不会出现循环功能的改变。严重皮下气肿，肺内气体流失（E错）可见于张力性气胸，但不是造成呼吸循环障碍的机制。